种植体外形设计，对种植体的骨结合有一定的影响，其中种植体外形指的是
A. 种植体的自身强度
B. 种植体与骨组织结合面积
C. 种植体应力的分布
D. 种植体缓冲装置
E. 以上均正确

正确答案：E。以上均正确

解析：种植体外形设计包括种植体的自身强度、与骨组织最大的结合面积、应力的合理分布、缓冲装置以及其表面不应有锐角等。掌握“牙种植术概论”知识点。